《素问·脉要精微论》“四变之动，脉与之上下”所体现的是
A. 整体观念
B. 辨证观念
C. 恒动观念
D. 形神一体观念
E. 五脏一体观念

正确答案：A。整体观念

解析：自然界有春、夏、秋、冬四时的变化，人体脉象也随之有春弦、夏洪、秋毛、冬石的变化。说明了人体脉象受四时的影响，如“春应中规，夏应中矩，秋应中衡，冬应中权。”原文从天人相应的观点出发，阐明了人体脉象的变化与四时阴阳变化相应的道理（A对）。